真寒假热或真热假寒的病机是
A. 阴阳偏盛
B. 阴阳偏衰
C. 阴阳格拒
D. 阴阳互损
E. 阴阳离决

正确答案：C。阴阳格拒

解析：阴阳格拒，是在阴阳偏盛基础上由阴阳双方相互排斥而出现寒热真假病变的一类病机，包括真寒假热或真热假寒两方面（C对）。阴阳偏盛，是指人体阴阳二气中某一方的病理性亢盛状态，属“邪气盛则实”的实性病机（A错）。阴阳偏衰，是指人体阴阳二气中某一方虚衰不足的病理状态，属“精气夺则虚”的虚性病机（B错）。阴阳互损，是指在阴或阳任何一方虚损的前提下，病变发展影响及相对的一方，形成阴阳两虚的病机（D错）。阴阳离决指由于阴阳失调，此消彼长发展到一方消灭另一方、或一方损耗过度而致另一方失去依存，无法再继续保持阴阳两者能动的相互关系，用以表示死亡的病理（E错）。